女性内生殖器官不包括
A. 卵巢
B. 输卵管
C. 子宫
D. 阴道
E. 前庭

正确答案：E。前庭

解析：本题考查女性的内生殖器。女性生殖系统分为内、外两部分。内生殖器（E错，为本题正确答案）包括阴道（D对）、子宫（C对）、输卵管（B对）和卵巢（A对）。外生殖器又称外阴，包括阴阜、大阴唇、小阴唇、阴蒂、前庭和会阴。进入青春期，随着下丘脑—垂体—卵巢轴发育日渐成熟，女性体内雌激素水平逐渐升高，在雌激素作用下，内、外生殖器官逐渐发育成熟。